下列对面肌的描述错误的是
A. 为扁薄的皮肌
B. 位置较深
C. 大多起于颅骨的不同部位
D. 止于皮肤
E. 无

正确答案：B。位置较深

解析：面肌为扁薄的皮肌（A对），位置浅表，而非较深（B错，为本题正确答案），大多起于颅骨的不同部位（C对），止于皮肤（D对）。